易发生GVHR的移植物是
A. 角膜
B. 骨髓
C. 皮肤
D. 肾脏
E. 肝脏

正确答案：B。骨髓